一克蛋白质供给能量
A. 16.7kJ
B. 20.7kJ
C. 24.7kJ
D. 34.7kJ
E. 35.7kJ

正确答案：A。16.7kJ